女，28岁。对与她交往的两个男朋友都很喜欢，于是咨询心理医生，并询问该医生如何选择，该医生只是帮其分析利弊，并没有回答其问题。该医生在这件事情上采取了
A. 真诚原则
B. 耐心原则
C. 保密原则
D. 中立原则
E. 回避原则

正确答案：D。中立原则

解析：根据第6版医学心理学，心理治疗的基本原则有信赖性原则、整体性原则、发展性原则、个性化原则、中立性原则、保密性原则。中立性原则要求治疗者在心理治疗的过程中保持中立的态度和立场。治疗者有自己的人生经历和人生价值取向。治疗者对治疗中涉及的各类事件均应保持客观、中立的立场，不把个人的观点强加给患者。此题中，对于患者提出的问题，咨询师最应注意中立性原则（D对），才能对患者的情况客观分析并提出适宜的处理方法。保密性原则（C错）是心理治疗的原则之一，它要求治疗者尊重患者的权利和隐私。真诚原则（A错）、耐心原则（B错）、回避原则（E错）均不是心理治疗的基本原则。